患者，男，56岁。有高血压病史4年。体检：血压156/96mmHg，无主动脉狭窄。医师处方依那普利片控制血压。服用2个月后，血压控制未达标，经进一步检查，该患者伴有同型半胱氨酸水平升高，宜联合应用的药品是
A. 维生素A
B. 维生素B₆
C. 维生素C
D. 烟酸
E. 叶酸

正确答案：E。叶酸

解析：本替考查叶酸。叶酸（E对）被还原成四氢叶酸，会参与氨基酸代谢，使同型半胱氨酸代谢，缓解同型半胱氨酸水平升高现象。维生素A（A错）用于预防夜盲症。维生素B₆（B错）用于维生素B₆缺乏症。维生素C（C错）用于预防坏血病、牙龈出血。烟酸（D错）用于糙皮病。